女，55岁。糖尿病病史1年，服用二甲双胍治疗出现明显胃肠道反应，改为格列齐特缓释片30mg/日治疗6个月，复查空腹血糖6.5mmol/L，餐后2小时血糖10mmol/L，HbAlc7.5%，时有午餐前心慌、出汗。查体：BP150/90mmHg，双下肢水肿，BMI30。该患者心慌、出汗的原因最可能是
A. 低血糖
B. 过敏反应
C. 高血压
D. 焦虑
E. 心律失常

正确答案：A。低血糖

解析：中老年女性患者，糖尿病病史1年，服用常规剂量（30～120mg）格列齐特缓释片，时有午餐前心慌、出汗，应考虑为出现了低血糖反应（A对）。格列齐特为第二代磺酰脲类口服降血糖药，属于胰岛素促泌剂，易发生低血糖反应（心慌、出汗、饥饿感等表现）。过敏反应（B错）虽然也是格列齐特的不良反应，但是症状为皮疹、皮肤瘙痒等。高血压（C错）、焦虑（D错）不会表现为餐前心慌、出汗。心律失常（E错）可出现心慌表现，但一般无规律性，不会仅于餐前出现，心电图会有异常表现。